癫痫最常见的症状是
A. 肢体肌肉强直性或阵挛性抽搐
B. 精神失常
C. 口吐涎沫
D. 凝视似怒
E. 口中作羊、鸡叫

正确答案：A。肢体肌肉强直性或阵挛性抽搐

解析：癫痫是由多种原因引起的脑部慢性疾患，其特点是脑内神经元反复发作性过度放电引起的突发性和暂时性脑功能异常，反复发作，发作形式多种多样，主要表现为一过性的神志丧失或意识改变，肢体肌肉强直或阵挛性抽搐，也可出现行为、情感、知觉等反面的异常（A对）。精神失常（B错）不是癫痫的临床症状。口吐涎沫（C错）、凝视似怒（D错）和口中作羊、鸡叫（E错）属于癫痫的临床表现，但不是癫痫最常见的症状。